关于奥司他韦作用特点的说法，错误的是
A. 奥司他韦可用于甲型和乙型流感的治疗
B. 应严格掌握奥司他韦适应证，不能用于流感的预防
C. 1岁以上儿童可以使用奥司他韦
D. 治疗流感时，首次使用奥司他韦应当在流感症状出现后的48小时以内
E. 奥司他韦治疗流感时，成人一次75mg，一日2次，疗程5日

正确答案：B。应严格掌握奥司他韦适应证，不能用于流感的预防

解析：本题考查奥司他韦的作用特点。奥司他韦可用于成人以及13岁和13岁以上青少年的甲型和乙型流感的预防（B错，为本题正确答案）。奥司他韦用于：（l）成人以及l岁和l岁以上儿童（C对）的甲型和乙型流感治疗（A对）。（2）成人以及13岁和13岁以上青少年的甲型和乙型流感的预防。奥司他韦治疗流行性感冒，首次用药的时间是在流感症状开始的第1或第2天开始治疗（D对）。奥司他韦在成人和 13岁以上青少年的推荐口服剂量是一次75mg，一日2次，连续5日（E对）。